女，27岁。发热1个月，伴关节肿痛、脱发和口腔溃疡。化验：尿蛋白（+++），红细胞20～30/HP。血ANA（+）。最可能的诊断是
A. 系统性红斑狼疮
B. 类风湿关节炎
C. 干燥综合征
D. 风湿热
E. 成人斯蒂尔病

正确答案：A。系统性红斑狼疮

解析：该患者为青年女性，根据临床症状、体征和实验室检查提示多系统病变。关节肿痛（骨关节系统），脱发和口腔溃疡，尿蛋白（+++），红细胞20-30/HP（肾脏损害），血ANA（+）（在SLE中抗核抗体滴度异常）。故最可能的诊断为系统性红斑狼疮（A对）。类风湿关节炎（RA）（B错）多表现慢性的、外周对称性多关节肿痛，后期可出现关节畸形，类风湿因子阳性（P808）。干燥综合征（C错）诊断有赖于口干燥症及干燥性角结膜炎的检测、抗SSA和（或）抗SSB抗体、唇腺灶性淋巴细胞浸润，后两项特异性较强（P830）。风湿热（RF）（D错）是一种咽喉部A组乙型溶血性链球菌（GAS）感染后反复发作的全身结缔组织炎症，主要累及关节、心脏、皮肤和皮下组织，偶可累及中枢神经系统、血管、浆膜及肺、肾等内脏。临床表现以关节炎和心脏炎为主。斯蒂尔病本是指系统型起病的幼年型关节炎，但相似的疾病也可发生于成年人，称为成人斯蒂尔病（AOSD）（E错），临床特征为发热、关节痛和/或关节炎、皮疹、肌痛、咽痛、淋巴结肿大、白细胞总数和中性粒细胞增多以及血小板增多，严重者伴系统损害。由于无特异诊断标准，常常需排除感染、肿瘤和其他结缔组织病后后才考虑其诊断。